秦艽的功效有
A. 祛风湿
B. 舒筋络
C. 消痰水
D. 清虚热
E. 利湿退黄

正确答案：A、B、D、E。祛风湿；舒筋络；清虚热；利湿退黄

解析：本题考查的是秦艽的功效。秦艽的功效有祛风湿（A对）、舒筋络（B对）、清虚热（D对）与利湿退黄（E对）。秦艽：【功效】祛风湿，舒筋络，清虚热，利湿退黄。威灵仙：【功效】祛风湿，通经络，消痰水（C错），治骨鲠。